秩和检验适用的资料类型不包括
A. 等级资料
B. 分布类型未知资料
C. 极度偏态分布资料
D. 数据一端不确定资料
E. 二项分布资料

正确答案：E。二项分布资料